55岁，女，体重76Kg，身高160cm。因多饮，多尿确诊为2型糖尿病，经饮食治疗和运动锻炼，2个月后空腹血糖为8.8mmol／L，餐后2小时血糖13.0mmol／L。进一步治疗应选择
A. 加磺脲类降血糖药物
B. 加双胍类降血糖药物
C. 加胰岛素治疗
D. 加口服降血糖药和胰岛素
E. 维持原饮食治疗和运动

正确答案：B。加双胍类降血糖药物

解析：中老年女性患者，体型肥胖，诊断为2型糖尿病，经饮食治疗和运动锻炼后血糖未控制在正常范围内，应及时应用药物治疗（P737）（E错）。2型糖尿病患者使用药物治疗，应首先选用口服降糖药物治疗，双胍类降血糖药物（B对）不增加体重，并可改善血脂谱、增加纤溶系统活性，有助于延缓或改善糖尿病的血管并发症，现已被我国推荐为2型糖尿病的一线用药（P738）。磺脲类降血糖药物（A错）作用于胰岛B细胞上的ATP敏感钾离子通道，促进胰岛素分泌，可加重胰岛B细胞负担，并增加患者体重，主要应用于新诊断的T2DM非肥胖患者（P737）。胰岛素（C错）在2型糖尿病中主要用于口服降糖药物效果不明显者或新诊断伴有明显高血糖，本例患者经饮食治疗与运动治疗后血糖非显著升高，可先试行口服降糖药物治疗。口服降糖药物与胰岛素联合治疗（D错）易导致低血糖反应，主要用于血糖明显升高难以控制者。